以下不符合肾小球源性血尿的是
A. 全程血尿
B. 无痛
C. 可见少量血丝
D. 变形红细胞为主
E. 可有红细胞管型

正确答案：C。可见少量血丝